砷引起的法定职业肿瘤为
A. 肺癌
B. 皮肤癌
C. 白血病
D. 脑瘤
E. 肺癌、皮肤癌

正确答案：E。肺癌、皮肤癌

解析：本题考查砷的致癌种类。在砷接触致癌的调查中，先后调查了13个工厂和居民区。结果显示共同的暴露因素是砷，并发现肺癌死亡率都明显升高，从而说明砷是引起肺癌高发的致癌物。长期职业性砷及其化合物暴露，可致手和脚掌有角化过度或蜕皮，典型的表现是手掌的尺侧缘、手指的根部有许多小的、角样或谷粒状角化隆起，俗称“砒疔”或“砷疔”，可融合成疣状物或坏死，继发感染形成经久不愈溃疡，可转变为皮肤原位癌（E对ABCD错）。